5岁幼儿嗜食坚果，某日该儿童出现眩晕，恶心，呕吐等症状来到医院就诊。来院后病情继续恶化，出现神志改变，惊厥、查体：瞳孔散大，对光反射迟钝，询问家长得知，患儿发病前服用过某种坚果。结合病情，医师推测患儿可能因误食某种坚果中毒，误食的坚果是
A. 桃仁
B. 榛子
C. 苦杏仁
D. 松子
E. 甜杏仁

正确答案：C。苦杏仁

解析：本题考查的是中药饮片的不良反应。出现眩晕，恶心，呕吐等症状来到医院就诊。来院后病情继续恶化，出现神志改变，惊厥、查体：瞳孔散大，对光反射迟钝，询问家长得知，患儿发病前服用过某种坚果。结合病情，医师推测患儿可能因误食某种坚果中毒，误食的坚果是苦杏仁（C对）。苦杏仁不良反应表现：苦杏仁的主要成分苦杏仁苷是其有效成分也是中毒成分，误服过量苦杏仁可发生氢氰酸中毒，使延髓等生命中枢先抑制后麻痹，并抑制细胞色素氧化酶的活性而引起组织窒息。临床表现为眩晕、心悸、恶心、呕吐等中毒反应，重者出现昏迷、惊厥、瞳孔散大、对光反应消失，最后因呼吸麻痹而死亡。